关于生物心理社会医学模式，下列提法中错误的是
A. 人们关于健康和疾病的基本观点
B. 21世纪建立起来的一种全新医学模式
C. 临床实践活动和医学科学研究的指导思想
D. 在更高层次上实现了对人的尊重
E. 不仅重视人的生物生存状态，而且更加重视人的社会生存状态

正确答案：B。21世纪建立起来的一种全新医学模式

解析：生物-心理-社会医学模式是20世纪70年代以后（B错，为本题正确答案）建立起来的一种全新的医学模式。生物-心理-社会医学模式是人们关于健康和疾病的基本观点（A对），是临床实践活动和医学科学研究的指导思想（C对）和理论框架，是医学实践的反映和理论概括。这种医学模式从生理、心理、社会等综合因素全面认识健康和疾病，在更高层次上实现了对人的尊重（D对），不仅重视人的生物生存状态，而且更加重视人的社会生存状态（E对）。